心输出量严重不足，患者肢端皮肤呈现斑状青紫，其原因下列哪项错误
A. 血流速度下降
B. 组织利用氧能力增加
C. 血小板数量减少
D. 循环时间延长
E. 静脉血氧含量下降

正确答案：C。血小板数量减少

解析：心衰时，心输出量降低，体循环淤血，因而血流速度下降（A对）、循环时间延长（D对）。组织细胞为适应心衰导致的供氧不足，发生线粒体增多、呼吸相关酶类活性增强等变化，使组织利用氧能力增加（B对），静脉血氧含量下降（E对），血液中还原血红蛋白增多，使肢端皮肤呈现斑状青紫，而此现象与血小板数量减少无关（C错，为本题正确答案）。